孕妇感染梅毒首选治疗药物是
A. 氧氟沙星
B. 阿奇霉素
C. 头孢曲松
D. 青霉素
E. 多西环素

正确答案：D。青霉素

解析：青霉素常用于治疗梅毒的首选治疗用药（D对）；氧氟沙星作为第三代喹诺酮类药物，常用于伤寒的首选治疗（A错）；阿奇霉素可用于淋病患者单次肌内注射的患者，是妊娠期感染沙眼衣原体首选用药（B错）；治疗淋病推荐联合使用头孢菌素和阿奇霉素，首选头孢曲松钠250mg（C错）；多西环素常用于治疗沙眼衣原体或支原体引起的感染（E错），妊娠期妇女禁用该药。